治疗瘰疬，瘿瘤，应首选的药物是
A. 夏枯草
B. 淡竹叶
C. 马齿苋
D. 地骨皮
E. 龙胆草

正确答案：A。夏枯草

解析：夏枯草应用于目赤肿痛，目珠夜痛，头痛眩晕，瘿瘤，瘰疬，乳痈，乳癖，乳房胀痛（A对）  淡竹叶应用于热病烦渴，口舌生疮，小便短赤涩痛不具有治疗瘰疬，瘿瘤的功能（B错）马齿苋应用于热毒血痢，痈肿疔疮，丹毒，蛇虫咬伤，湿疹，便血，痣血，崩漏下血不具有治疗瘰疬，瘿瘤的功能（C错）  地骨皮应用于阴虚潮热，骨蒸盗汗，肺热咳嗽，咳血，内热消渴不具有治疗瘰疬，瘿瘤的功能（D错）  龙胆草应用于湿热黄疸，阴肿阴痒，带下，湿疹瘙痒，肝火头痛，目赤肿痛，耳鸣耳聋，胁痛口苦，强中，惊风抽搐不具有治疗瘰疬，瘿瘤的功能（E错）综上可知治疗瘰疬，瘿瘤，应首选的药物是夏枯草